健脾丸中有的药物是
A. 白术、木香、连翘
B. 白术、茯苓、连翘
C. 白术、木香、茯苓
D. 白术、茯苓、半夏
E. 白术、木香、半夏

正确答案：C。白术、木香、茯苓

解析：本题考查方剂的组成。健脾丸组成，白术 木香 黄连 甘草 白茯苓 人参 神曲 陈皮 砂仁 麦芽 山楂 山药 肉豆蔻 （C对）。